促进组织对葡萄糖摄取和利用的药物是
A. 阿卡波糖
B. 二甲双胍
C. 甲巯咪唑
D. 硫唑嘌呤
E. 格列本脲

正确答案：B。二甲双胍

解析：本题考查二甲双胍的作用机制。二甲双胍（B对）为双胍类口服降糖药，通过促进组织对葡萄糖的摄取和利用，抑制葡萄糖在肠道的吸收，降低血糖。阿卡波糖（A错）属于α-葡萄糖苷酶抑制剂。格列本脲（E错）是磺酰脲类降糖药，通过刺激胰岛B细胞释放胰岛素降低血糖。甲巯咪唑（C错）属于硫脲类抗甲状腺药，通过抑制甲状腺内的过氧化物酶，进而抑制酪氨酸的碘化和偶联，抑制甲状腺激素的生物合成。巯唑嘌呤（D错）为免疫抑制药。